肌皮神经损伤后可导致
A. 臂不能后伸
B. 臂不能外展
C. 臂不能内收
D. 前臂不能屈
E. 前臂旋前力量减弱

正确答案：D。前臂不能屈

解析：肌皮神经支配喙肱肌、肱二头肌和肱肌，损伤后导致前臂不能屈（D对）。腋神经损伤导致臂不能内收（C错）。